依据行政管理法规而产生的是
A. 行政处分
B. 行政处罚
C. 行政责任
D. 行政行为
E. 行政复议

正确答案：C。行政责任

解析：依据行政管理法规而产生的是行政责任。卫生行政责任，是指卫生行政法律关系主体违反卫生行政法律规范，尚未构成犯罪所应承担的法律后果（C对）。行政处分是指有管辖权的卫生行政机关或医疗卫生机构对所属一般违法失职人员给予的一种行政制裁（A错）。行政处罚是指卫生行政机关或者法律法规授权组织，在职权范围内对违反卫生行政管理秩序而尚未构成犯罪的公民、法人和其他组织，实施的一种卫生行政制裁（B错）。具体卫生行政行为是针对某特定人、特定事物、特定对象等作出的直接对相对人产生法律后果的行政行为（D错）。卫生行政复议，是指公民、法人或者其他组织认为卫生行政机关的具体行政行为侵犯其合法权益，按照法定的程序和条件向作出该具体行政行为的上一级卫生行政机关提出申请，受理申请的行政机关对该具体行政行为进行复查，并作出复议决定的活动（E错）。